不属于抗原-抗体反应相关检测技术的是
A. 流式细胞术
B. 血凝抑制
C. 免疫荧光
D. 放射免疫
E. 酶免疫

正确答案：A。流式细胞术